患者，男，53岁。形体肥胖，胸闷胸痛反复发作1周，含服硝酸甘油1～2分钟可缓解。痰多色白，纳呆，脘胀，形寒肢冷，舌淡苔白滑，脉弦滑。其治法是
A. 通阳泄浊，益气养阴
B. 豁痰散结，益气补血
C. 豁痰化痰，行气止痛
D. 通阳泄浊，豁痰散结
E. 疏肝理气，活血化痰

正确答案：D。通阳泄浊，豁痰散结

解析：患者形体肥胖，痰浊盘踞，胸阳失展，气机痹阻，脉络阻滞，故见胸闷胸痛反复发作，痰多色白；痰浊困脾，脾气不运，则纳呆，脘胀；胸阳不振，故形寒肢冷；舌淡苔白滑，脉弦滑均属于痰浊内阻之侯。治法为通阳泄浊，豁痰散结（D对）。通阳泄浊，益气养阴（A错）治疗气阴两虚，痰浊内阻证。豁痰散结，益气补血（B错）治疗气血两虚，痰浊内阻证。豁痰化痰，行气止痛（C错）治疗气滞痰阻证。疏肝理气，活血化痰（E错）治疗气滞血瘀证。